患儿，10个月。鼻塞流涕2天后，泻下清稀，中多泡沫，腹痛肠鸣。治疗应首选
A. 保和丸
B. 桑菊饮
C. 藿香正气散
D. 参苓白术散
E. 七味白术散

正确答案：C。藿香正气散

解析：患儿泻下清稀，中多泡沫，腹痛肠鸣，当属泄泻范畴，其有风则见多泡沫，有寒则见腹痛肠鸣，鼻塞流涕，治当疏风散寒，化湿和中，方用藿香正气散加减（C对）。保和丸功能运脾和胃，消食化滞，用于泄泻之伤食泻（A错）。桑菊饮功能疏风解热，宣肺止咳，用于风热咳嗽（B错）。参苓白术散功能健脾益气，助运止泻，用于泄泻之脾虚泻（D错）。七味白术散功效主要是健脾生津，行气消胀，用于治疗脾胃久虚，津液内耗，呕吐泄泻频作，烦渴多饮（E错）。